Kennedy第四类多数前牙缺失，为了美观直接固位体一般不放在
A. 第一前磨牙
B. 第二前磨牙
C. 第一磨牙
D. 第二磨牙
E. 磨牙上

正确答案：A。第一前磨牙

解析：Kennedy第四类的设计要点：多数前牙缺失，直接固位体放在第一前磨牙以后的牙齿上，以免影响美观。掌握“局部义齿的设计”知识点。